下列非人为污染源为
A. 汽车尾气
B. 工业三废
C. 森林火灾
D. 化肥农药
E. 生活污水

正确答案：C。森林火灾

解析：本题考查非人为污染源。污染源可分为人为污染源和非人为污染源。人为污染源是由于人们的生产和生活活动造成的污染，如汽车尾气（A错）、工业三废（B错）、化肥农药（D错）和生活污水（E错）等。非人为污染源是指由于自然原因形成的污染，如森林火灾（C对）、沙尘暴、火山爆发等。